经期延长阴虚血热证的发病机制是
A. 阴虚失守，冲任不固
B. 肝郁气滞，疏泄失常
C. 肾阴不足，封藏失职
D. 阴虚内热，热扰冲任
E. 湿热下注，血热妄行

正确答案：D。阴虚内热，热扰冲任

解析：血热证包括虚热证和实热证。阴虚内热，热扰冲任，冲任不固，经血失约，故经行时间延长（D对）。阴为阳之守，阴气亏虚，阳气内动，冲任不固，而致经间期出血（A错）。郁怒伤肝，疏泄失常，冲任失调，血海蓄溢无常致月经先后不定期（B错）。肾阴不足，精血亏虚，冲任血虚，血海不能按时满溢，可致月经后期、月经过少、闭经等（C错）。脾胃虚弱，不能运化水谷精微以生血，反聚而生湿，湿邪蕴而生热，湿热下注，血热妄行，致出血，属经间期出血之湿热证（E错）。